在氯霉素滴眼剂处方中,下列物质的作用是：氯化钠
A. 渗透压调节剂
B. 抑菌剂
C. 抗氧剂
D. 金属离子络合剂
E. pH调节剂

正确答案：A。渗透压调节剂

解析：本题考查用作滴眼剂渗透压调节剂的辅料。氯化钠为渗透压调节剂（A对），可调整滴眼液的渗透压；抑菌剂（B错）为抑制微生物生长繁殖的物质，如硝酸苯汞；抗氧剂（C错）可抗药物氧化，如亚硫酸氢钠；金属离子络合剂（D错）有乙二胺四乙酸二钠；pH调节剂（E错）可调节滴眼液的酸碱度，如硼酸盐缓冲液。